根据《中共中央、国务院关于深化医疗保障制度改革的意见》，力争到2030年全面建成多层次医疗保障制度体系。多层次医疗保障制度体系的主体是
A. 补充医疗保险
B. 医疗互助
C. 医疗救助
D. 基本医疗保险

正确答案：D。基本医疗保险

解析：本题考查多层次医疗保障制度体系的组成。根据《中共中央国务院关于深化医疗保障制度改革的意见》，力争到2030年全面建成多层次医疗保障制度体系。多层次医疗保障制度体系的主体是基本医疗保险（D对）。基本医疗保险、补充医疗保险与医疗救助具有保障功能，基本医疗保险是保障体系主体，医疗救助（C错）在保障体系中发挥托底作用，补充医疗保险（A错）、商业健康保险、慈善捐赠、医疗互助（B错）等是重要组成。